某男，35岁。昨日因饮食不洁导致泄泻腹痛，泻下急迫，势如水注，气味臭秽，肛门灼热，烦热口渴，小便短黄。诊断为泄泻，证属湿热伤中。可选用的中成药有
A. 肠胃宁片
B. 肠康片
C. 固本益肠片
D. 泻痢消胶囊
E. 白蒲黄片

正确答案：B、D、E。肠康片；泻痢消胶囊；白蒲黄片

解析：本题考查泄泻之湿热伤中证的常用中成药。泄泻湿热伤中证可选用的中成药是肠康片（B对）、泻利消胶囊（D对）、白蒲黄片（E对）。泄泻之湿热伤中证【症状】泄泻腹痛，泻下急迫，势如水注，或泻而不爽，粪色黄褐，气味臭秽，肛门灼热，烦热口渴，小便短黄。舌质红，苔黄腻，脉滑数或濡数。【中成药应用】肠康片、香连片、痢必灵片（糖衣片）、泻痢消胶囊、连蒲双清片、白蒲黄片。泄泻之肾阳虚衰证【症状】黎明前脐腹作痛，肠鸣即泻，泻后则安，完谷不化，腹部喜暖，形寒肢冷，腰膝酸软。舌淡苔白，脉沉细。【中成药应用】肠胃宁片（A错）、固本益肠片（C错）。